个体的强烈需求或过高的期望属于
A. 躯体性应激源
B. 心理性应激源
C. 社会性应激源
D. 职业性应激源
E. 文化性应激源

正确答案：B。心理性应激源